可变区是指
A. 重链和轻链羧基端的氨基酸序列变化较少
B. 重链氨基端1/4或1/5区域和轻链氨基端1/2区域的氨基酸序列多变
C. 重链氨基端1/2或1/5区域和轻链氨基端1/2区域的氨基酸序列多变
D. 重链氨基端1/3或1/5区域和轻链氨基端1/2区域的氨基酸序列多变
E. 重链氨基端1/4或1/5区域和轻链氨基端1/4区域的氨基酸序列多变

正确答案：B。重链氨基端1/4或1/5区域和轻链氨基端1/2区域的氨基酸序列多变

解析：Ig单体由两条相同的重链和两条相同的轻链由链间二硫键连接组成。重链氨基端1/4或1/5区域和轻链氨基端1/2区域的氨基酸序列多变，称为可变区（V区）。重链和轻链羧基端的氨基酸序列变化较少，称为恒定（constant）区（C区）。掌握“免疫球蛋白基本概念及结构”知识点。